急性根尖周脓肿时，医生建立最佳的引流通道是
A. 根尖孔-根管-龋洞
B. 根尖部-牙周袋
C. 根尖部-齿槽骨-黏膜下
D. 根尖部-齿槽骨-皮肤下
E. 根尖部-牙周间隙-龈袋

正确答案：A。根尖孔-根管-龋洞

解析：本题考查急性根尖周脓肿的最佳引流通道。急性根尖周脓肿疼痛症状较重、病程长，脓液从根尖周自行向外排除常需五、六天，此时，需医生建立排脓通道，以利于根尖周脓肿引流，缓解患者痛苦，促进愈合。具体操作是在局麻下开通髓腔，穿通根尖孔，建立引流通道，使根尖渗出物及脓液通过根管得到引流即引流通道为根尖孔-根管-龋洞（A对），此种引流对根周膜破坏少，患者痛苦小，预后良好，为最佳排脓途径。当通过根尖部-牙周袋（B错）及根尖部-牙周间隙-龈袋（E错）引流时，容易加重牙周病变使患牙松动，甚至脱落。当通过根尖部-齿槽骨-黏膜下（C错）及根尖部-齿槽骨-皮肤下 （D错）引流时，会形成经久不愈的窦道，加重患者痛苦。